属于非离子型的表面活性剂是
A. 十二烷基苯磺酸
B. 卵磷脂
C. 月桂醇硫酸钠
D. 聚氧乙烯-聚氧丙烯共聚物
E. 硬脂酸钾

正确答案：D。聚氧乙烯-聚氧丙烯共聚物

解析：本题考查非离子型表面活性剂。聚氧乙烯-聚氧丙烯共聚物（D对）属于非离子型表面活性剂；十二烷基苯磺酸钠（A错）、月桂醇硫酸钠（C错）、硬脂酸钾（E错）均属于阴离子表面活性剂；卵磷脂（B错）属于两性离子表面活性剂。